以下含吲哚美辛的是
A. 冠心通
B. 新癀片
C. 抗感灵
D. 消咳定
E. 强力康

正确答案：B。新癀片

解析：本题考查的是含西药组分的中成药。以下含吲哚美辛的是新癀片（B对）。新癀片：功能清热解毒，活血化瘀，消肿止痛。用于热毒瘀血所致的咽喉肿痛、牙痛、痹痛、胁痛、黄疸、无名肿毒。含西药成分吲哚美辛。抗感灵（C错）片：功能解热镇痛，消炎。用于感冒引起的鼻塞，流涕，咽部痒痛，咳嗽头痛，周身酸痛，发热及由感冒引起的扁桃体炎。含西药成分：对乙酰氨基酚。冠心通（A错）、消咳定（D错）与强力康（E错）所含西药成分，2022年考试指南未明确说明。